男，35岁。劳累后发热、咳嗽、咳脓性痰3天，呼吸困难1天。查体：T38.9℃，R30次/分，口唇发绀，右下肺叩诊呈浊音，呼吸音略低。引起该患者低氧血症的主要机制是
A. 限制性通气功能障碍
B. 肺泡通气量下降
C. 生理无效腔增加
D. 弥散功能障碍
E. 通气/血流比例失衡

正确答案：E。通气/血流比例失衡

解析：中青年男性患者，劳累后（肺部感染性疾病诱因）发热、咳嗽、咳脓性痰3天，呼吸困难1天（肺炎症状），查体T38.9℃，R30次/分（严重感染症状），口唇发绀（缺氧），右下肺叩诊呈浊音（提示肺实变），呼吸音略低（肺炎体征），根据患者临床表现、体征，最可能的诊断是肺炎，肺炎链球菌肺炎可能性大，此时患者缺氧产生低氧血症，最主要的原因是通气/血流比例失衡（E对），因为肺组织发生病变时，由于病变轻重程度与分布不均匀，使得各部分肺的通气与血流的比例不平衡，造成严重的肺泡通气与血流的比例失调，导致肺换气功能障碍。限制性通气功能障碍（A错）见于呼吸肌麻痹、肺和胸廓的扩张性变化，以及气胸等引起的肺扩张受限性疾病。每一次呼吸的肺通气量，能进行有效气体交换的部分称为肺泡通气量，另一部分为生理无效腔。肺泡通气量下降（B错）见于肺通气量下降，如各种阻塞性通气障碍，和（或）生理无效腔量增大，且与呼吸频率、呼吸深度有关，深而慢的呼吸有利于增加肺泡通气量，该患者呼吸频率明显增快，会出现肺泡通气量下降，但非造成低氧血症的主要原因。生理无效腔（C错）生理情况下为解剖无效腔；病理情况下，为肺部无效腔和解剖无效腔的总和。解剖无效腔与个人体重相关，为定值；肺泡无效腔增加见于肺栓塞及各种疾病引起的肺血流量下降，反应肺换气功能。弥散功能障碍（D错）多见于肺纤维化、肺水肿、ARDS等以呼吸膜增厚为主要病理表现的疾病。